急性胰腺炎诊断中，不正确的是
A. 血清淀粉酶在发病后2～12小时开始升高
B. 血清淀粉酶在发病后24～48小时达到高峰
C. 血清淀粉酶值高于128Winslow单位
D. 血清淀粉酶值高低与病情轻重呈正比
E. 尿清淀粉酶在发病后12～24小时后上升

正确答案：D。血清淀粉酶值高低与病情轻重呈正比

解析：血清淀粉酶值高低与诊断正确率呈正比，但血清淀粉酶值高低与病情轻重不呈正比（D错，为本题正确答案）。急性轻症胰腺炎表现为血淀粉酶增高，急性重症胰腺炎血淀粉酶值可正常或低于正常值。血清淀粉酶在发病后2～12小时开始升高（A对），24小时达到高峰（B对）；尿淀粉酶在发病后24小时后上升（E对），48小时到达高峰。淀粉酶采用国际单位U/L，以往血淀粉酶使用Somogyi单位，尿淀粉酶使用Winslow单位，若血清淀粉酶大于128 Winslow单位（C对），尿淀粉酶大于256 Winslow单位，可诊断急性胰腺炎（一版内科学P386）。注：本题中部分数据与九版内、外科学有出入。